不属于下颌神经的是
A. 棘孔神经
B. 颞深神经
C. 咬肌神经
D. 颊长神经
E. 颧神经

正确答案：E。颧神经

解析：颧神经属于上颌神经，其它几项均属于下颌神经。掌握“三叉神经的分支与分布”知识点。